执业药师对医师开展用药咨询服务的内容包括
A. 价格信息
B. 新药信息
C. 合理用药信息
D. 药物相互作用和禁忌证
E. 药品不良反应信息

正确答案：B、C、D、E。新药信息；合理用药信息；药物相互作用和禁忌证；药品不良反应信息

解析：本题考查的是医师用药咨询。执业药师对医师开展用药咨询服务的内容包括新药信息（B对）、合理用药信息（C对）、药物相互作用和禁忌证（D对）与药品不良反应（E对）。执业药师可从以下几个方面向医师提供用药咨询服务：1.新药信息。2.合理用药信息。3.药品不良反应。4.药物相互作用和禁忌证。价格信息（A错）是执业药师对患者开展用药咨询服务的内容。患者咨询的内容一般可分为：（1）药品名称。（2）适应病证。（3）用药禁忌。（4）用药方法。（5）用药剂量。（6）服药后预计疗效及起效时间、维持时间。（7）药品的不良反应与药物相互作用。（8）有否替代药物或其他疗法。（9）药品的鉴定辨识、贮存和有效期。（10）药品价格、报销，是否进入医疗保险报销目录等。